男，3岁。出生时正常，母乳喂养，5个月后智能渐落后，头发变黄，肤色变白，多动，有肌痉挛，尿有鼠尿臭味。主要的治疗是
A. 鲁米那
B. 维生素D
C. 脑活素
D. 低铜饮食
E. 低苯丙氨酸饮食

正确答案：E。低苯丙氨酸饮食

解析：苯丙酮尿症患儿由于体内无法进行苯丙氨酸的正常代谢，苯丙氨酸大量通过旁路代谢的产物堆积会对机体造成损害，因此应尽早进行低苯丙氨酸饮食（E对），至少持续至青春期，终生治疗对患者更有益。鲁米那（A错），即苯巴比妥，用于镇静催眠；维生素D（B错）用于治疗维生素D缺乏性佝偻病；脑活素（C错）用于神经衰弱，脑动脉硬化引起的体倦头晕、中风、半身不遂、高血压性脑出血后的脑血肿、脑血栓；低铜饮食（D错）可缓解肝豆状核变性。